由多种原因引发的牙龈部位纤维结缔组织增生为主要病理改变的一组疾病，称为
A. 牙周萎缩
B. 牙周炎
C. 增生性龈炎
D. 慢性龈炎
E. 剥脱性龈病损

正确答案：C。增生性龈炎

解析：本题考查牙龈疾病。由多种原因引发的牙龈部位纤维结缔组织增生为主要病理改变的一组疾病，称为增生性龈炎（C对）。龈增生主要指由多种原因引发的以纤维结缔组织增生为主要病理改变的一组疾病，又称增生性龈炎。